小儿，智力低下，四肢萎软，精神呆滞，言语不清晰，肌肤苍白，发稀萎黄，大便秘结，舌淡红，无苔，脉细。治疗应首选方剂
A. 右归丸
B. 菖蒲丸
C. 左归丸
D. 归脾汤
E. 八珍汤

正确答案：B。菖蒲丸

解析：根据患儿临床表现为智力低下，四肢萎软，精神呆滞，言语不清晰等症状，不符合正常小儿生长发育，故诊断为五迟。心主神明，心气虚弱，脑髓未充，神气不足，故智力低下，精神呆滞；脾主四肢肌肉，开窍于口，摄取精微化生气血，脾虚生化乏源，气血不荣脏腑肌肤，故见四肢萎软，纳食欠佳，大便秘结；心之声为炎，心气不足，神窍不利，故言语不清晰；心血不足，不能华色，故肌肤苍白；心主血，脾生血，发为血之余，心脾两虚，血不荣发，故发迟难长，发稀萎黄；舌淡无苔，脉细，为心脾两亏，气血虚弱之象，故其证候心脾两虚证，治以补心养血 方药为菖蒲丸（B对）。右归丸（A错）其功用为温补肾阳，填精益髓，适用于肾阳不足，命门火衰证。左归丸（C错）其功用为滋阴补肾，填精益髓，适用于真阴不足证。归脾汤（D错）其功用为益气补血，健脾养心，适用于心脾气血两虚证或脾不统血证。八珍汤（E错）其功用为益气补血，适用于五软之气血虚弱证。